雌二醇口服几乎无效，临床常用雌二醇贴片。近年来，随着微粒化技术问世，市面上亦出现了雌二醇片。某患者使用微粒化雌二醇片治疗雌激素缺乏综合征，每次2mg，每天服药一次，使用一段时间后，出现肝功能异常，后改用雌二醇贴片（每片2.5mg，每片可使用7日），不良反应消失。关于雌二醇应用及不良反应的说法，正确的是
A. 发生不良反应的原因与雌二醇本身的药理作用有关
B. 雌二醇口服几乎无效的主要原因，是因为雌二醇溶解度低
C. 使用贴片后不良反应消失，是因为雌二醇缓慢而直接进入体循环
D. 发生不良反应的原因是雌二醇的代谢产物具有毒性
E. 使用贴片后不良反应消失，是因为贴片主要作用于皮肤

正确答案：C。使用贴片后不良反应消失，是因为雌二醇缓慢而直接进入体循环

解析：本题考查贴剂。使用贴片后不良反应消失，是因为雌二醇缓慢而直接进入体循环（C对E错）。贴剂系指原料药物与适宜的材料制成的供粘贴在皮肤上的可产生全身或局部作用的一种薄片状制剂。贴剂的优点有：（1）避免了口服给药可能发生的肝首关效应及胃肠灭活，药物可长时间持续扩散进入血液循环，提高了治疗效果。（2）维持恒定有效的血药浓度，增强治疗效果，减少胃肠给药的副作用。（3）延长作用时间，减少用药次数，改善患者用药顺应性。（4）避免峰谷现象，降低药物不良反应。（5）患者可以自行用药，适用于婴幼儿、老人和不宜口服给药及需长期用药的患者。（6）发现副作用可随时中断给药。